制备时需加崩解剂的片剂是
A. 缓释片
B. 口含片
C. 舌下片
D. 浸膏片
E. 咀嚼片

正确答案：D。浸膏片

解析：本题考查的是片剂的崩解剂。制备时需加崩解剂的片剂是咀嚼片（D对）。崩解剂：系指能促使片剂在胃肠液中迅速崩解成小粒子而更利于药物溶出的辅料。崩解剂的主要作用是消除因黏合剂和高度压缩而产生的结合力。除口含片（B错）、舌下片（C错）、缓释片（A错）、咀嚼片（E错）等，一般片剂均需加用崩解剂。常用的崩解剂有干燥淀粉、羧甲淀粉钠、低取代羟丙纤维素、泡腾崩解剂、崩解辅助剂等。